男性，36岁，1周来上腹痛，反酸，2小时前疼痛加重，呕血约200ml，呕血后疼痛减轻。考虑是哪种疾病
A. 急性胃炎
B. 消化性溃疡
C. 慢性胃炎
D. 胃癌
E. 应激性溃疡

正确答案：B。消化性溃疡

解析：胃溃疡表现为餐后约0.5～1小时发生，经1～2小时后逐渐缓解，至下餐进食后再重复上述节律。故本题考虑最有可能确诊消化性溃疡。掌握“消化性溃疡”知识点。